医疗机构的下列行为中，不违反《医疗机构管理条例》的是
A. 未将执业许可证、收费标准等悬挂于明显处所
B. 工作人员上岗工作未按规定佩带标牌
C. 未按规定办理校验手续
D. 擅自增加医师人数
E. 擅自涂改执业许可证

正确答案：D。擅自增加医师人数

解析：本题除了D项，其他四项均为违反医疗机构执业规则的行为。掌握“医疗机构概述及机构执业”知识点。